干眼症可选用
A. 色甘酸钠滴眼液
B. 七叶洋地黄双苷滴眼液
C. 玻璃酸钠滴眼液
D. 氧氟沙星滴眼液
E. 碘苷滴眼液

正确答案：C。玻璃酸钠滴眼液

解析：本题考查干眼症用药。玻璃酸钠滴眼液（C对）可用于干眼症。使用人工泪液（玻璃酸钠滴眼液、羟甲基纤维素钠滴眼液、聚乙烯醇滴眼液等）可用于改善眼部干燥症状。局部使用七叶洋地黄双苷滴眼液（B错）改善睫状肌功能和增加睫状肌血流量以改善眼部调节功能，减轻眼部不适。色甘酸钠滴眼液（A错）可用于治疗过敏性结膜炎和春季卡他性结膜炎。氧氟沙星滴眼液（D错）用于急性卡他性结膜炎未彻底治愈而转变为慢性结膜炎者，由细菌所致的结膜炎。碘苷滴眼液（E错）可用于治疗流行性结膜炎。